属于疾病名称的是
A. 湿热
B. 肝郁
C. 瘀血
D. 暑湿
E. 感冒

正确答案：E。感冒

解析：本题考查的是疾病名称。属于疾病名称的是感冒（E对）。感冒是感受风邪或时行病毒，卫表失和而导致的常见外感疾病。湿热（A错），为致病因素，属于六淫风、寒、暑、湿、燥、火（热）中的两邪。肝郁（B错）是指肝失疏泄，气机郁滞，以情志抑郁、胸胁或少腹胀痛等为主要表现的证候。又称肝气郁结证。瘀血（C错）病因之一。凡离经之血积存体内，或血行不畅，阻滞于经脉及脏腑内的血液，均称为瘀血。暑湿（D错），即暑热挟湿。以胸脘痞闷、心烦、身热、舌苔黄腻为主证。多发生于夏令季节，暑湿俱盛之时，尤以南方为多见。